女，31岁。停经21周。剧烈腹痛，发热１天，伴恶心、呕吐，无阴道流血。查体：宫底平脐，子宫前壁压痛，胎心156次/分。血WBC13×10⁹/L，N0.78。彩超提示单胎妊娠合并子宫肌壁间肌瘤，肌瘤直径7cm，最可能是子宫肌瘤发生
A. 感染
B. 玻璃样变
C. 红色样变
D. 肉瘤样变
E. 囊性变

正确答案：C。红色样变

解析：该患者彩超提示单胎合并子宫肌壁间肌瘤，且患者有剧烈腹痛，发热1天，伴恶心、呕吐的症状，查体有子宫前壁压痛，实验室检查提示血WBC13×10⁹/L，N0.78，考虑为子宫肌瘤发生红色样变（C对）。红色样变性多见于妊娠期或产褥期，为肌瘤的一种特殊类型坏死，发生机制不清，可能与肌瘤内小血管退行变引起血栓及溶血、血红蛋白渗入肌纤维间有关。子宫肌瘤发生肉瘤样变（D错）时多见于绝经后子宫肌瘤伴疼痛和出血的患者。感染（A错）这个选项本身不对。子宫肌瘤可发生玻璃样变（B错）及囊性变（E错），但依据该患者的症状，不予考虑。